小儿结核性脑膜炎晚期表现为
A. 颈项强直
B. 定向障碍
C. 剧烈疼痛
D. 轻度性格改变
E. 昏迷

正确答案：E。昏迷

解析：结核性脑膜炎（P194）根据临床表现可分为三期，早期（前驱期）、中期（脑膜刺激征期）、晚期（昏迷期）。早期主要症状为轻度性格改变（D错）。中期因颅内压增高致剧烈头痛（C错）、喷射性呕吐、嗜睡或烦躁不安、惊厥等，出现明显脑膜刺激征（A错），部分患儿出现脑炎症状及体征，如定向（B错）、运动和（或）语言障碍。晚期的典型表现为昏迷（E对）。